哮喘急性发作应用平喘药，最适宜的给药途径是
A. 吸入给药
B. 口服给药
C. 静脉滴注
D. 肌内注射
E. 经皮给药

正确答案：A。吸入给药

解析：本题考查给药途径。哮喘急性发作应用平喘药，最适宜的给药途径是吸入给药（A对）。平喘药规范应用吸入给药,β₂受体激动剂首选吸入给药,包括定量气雾剂吸入、干粉吸入、持续雾化吸入,药物吸入气道后直接作用于呼吸道,局部浓度高且起效迅速,只需较小剂量,全身性不良反应较少。